阿米巴病时，咯血的特征为
A. 铁锈色痰
B. 烂桃样痰
C. 浆液性粉红色泡沫样血痰
D. 巧克力色脓痰
E. 咯鲜血

正确答案：D。巧克力色脓痰